不属于克山病的临床类型的是
A. 急型
B. 亚急型
C. 慢型
D. 潜在型
E. 过敏型

正确答案：E。过敏型

解析：本题考查克山病的临床类型。克山病是一种以心肌变性坏死为主要病理改变的生物地球化学性疾病。其临床类型有：1.急型克山病（A对）：多见于成人和大龄儿童，具有起病急、病情危重、变化较快等特点；2.亚急型克山病（B对）：是小儿克山病常见类型。主要表现为心脏扩大、水肿，常在数日内发生心力衰竭，可合并心源性休克；3.慢型克山病（C对）：此型起病缓慢，多在不知不觉中发病，亦称“ 自然慢型克山病”；4.潜在型克山病（D对）：此型心肌病变较轻，心脏功能代偿良好，多能参加劳动，仅在普查中通过心电图检查才能发现。过敏型（E错，为本题正确答案）不属于克山病的临床类型。